某学者在某地进行吸烟与肺癌关系的研究，结果显示：该地人群肺癌年死亡率为0.56%，吸烟与不吸烟者的肺癌年死亡率分别为0.96%和0.07%，该项研究的相对危险度RR为
A. 92.7
B. 0.07
C. 13.71
D. 1.71
E. 8

正确答案：C。13.71

解析：本题考查相对危险度的计算。相对危险度是暴露组的危险度（测量指标是累积发病率）与对照组的危险度之比。计算为相对危险度＝0.96%/0.07%＝13.71（C对ABDE错）。